某县暴发传染病学，县政府主要领导以稳定发展经济为由，要求并指示有关机构隐瞒传染疫情，造成传染病学传播流行，该主要领导应依法承担的行政责任是
A. 行政处分
B. 行政处罚
C. 行政赔偿
D. 行政拘留
E. 行政裁决

正确答案：A。行政处分

解析：地方各级入民政府未依照规定履行报告职责，或者隐瞒、谎报、缓报传染病疫情，或者在传染病暴发、流行时，未及时组织救治、采取控制措施的，由上级人民政府责令改正，通报批评；造成传染病传播、流行或者其他严重后果的，对负有责任的主管入员，依法给予行政处分（A对）；构成犯罪的，依法追究刑事责任。